男，65岁。发热，咳嗽4天，查体：T39℃，口唇发绀，双下肺可闻及湿啰音，既往体健，否认肺部疾病病史，SPO₂85%，肺部X线片示双下肺感染，可作为经验性抗感染治疗首选的药物是
A. 三代头孢菌素
B. 碳青霉烯类
C. 大环内酯类
D. β-内酰胺类/β-内酰胺酶抑制剂＋氟喹诺酮类
E. 氟喹诺酮类＋氨基糖苷类

正确答案：D。β-内酰胺类/β-内酰胺酶抑制剂＋氟喹诺酮类

解析：患者老年男性，发热，咳嗽4天，查体：T39℃（正常腋温36～37℃），口唇发绀（提示缺氧），双下肺可闻及湿啰音，既往体健，否认肺部疾病病史，SPO₂85%（正常值＞95%），肺部X线片示双下肺感染。根据患者症状、体征及影像学表现，考虑诊断为重症肺炎，应联合用药，但缺乏明确分类指标，先根据经验用药选择β-内酰胺类/β-内酰胺酶抑制剂＋氟喹诺酮类 （D对）进行广谱治疗，其抗菌谱广，对革兰阳性菌及阴性菌均有强大的抗菌作用，对厌氧菌和肺炎支原体也有良好作用。三代头孢菌素（A错）主要用于球菌和杆菌的治疗，覆盖面不够广。碳青霉烯类（B错）在其他药物治疗效果不佳时使用。大环内酯类（C错）主要用于支原体感染的治疗，支原体感染多见于儿童及青少年。氟喹诺酮类＋氨基糖苷类（E错）主要用于克雷伯杆菌肺炎、铜绿假单胞菌肺炎。